患者，男，46岁，诊断为低钾血症，心电图显示正常心律，若外周静脉滴注氯化钾，为防范局部疼痛及心脏停搏风险，配置的适宜浓度是
A. 低于0.3%
B. 0.3%～0.5%
C. 0.5%～1.0%
D. 1.0%～1.5%
E. 高于1.5%

正确答案：A。低于0.3%

解析：本题考查氯化钾的使用。氯化钾的注意事项中，静脉补钾浓度一般不宜超过40mmol/L（0.3%）（A对），滴速不宜超过750mg/h（10mmol/h），否则可引起局部剧烈疼痛，且有导致心脏停搏的危险。在应用高浓度钾治疗体内缺钾引起的严重快速型、尖端扭转型室性心律失常时，应在心电图监护下给药。